列哪项不是生物-心理-社会医学模式产生的背景
A. 人类面临的疾病谱与死因谱发生变化
B. 人类健康需求的与日俱增
C. 医学科学与相关学科的相互渗透
D. 健康影响因素的多元化
E. 社会的进步与发展

正确答案：E。社会的进步与发展